某男，68岁。眩晕，头重昏蒙，伴视物旋转，胸闷恶心，食少多寐；舌苔白腻，脉满。应采用的治法是
A. 补益气血，调养心脾
B. 滋养肝肾，益精填髓
C. 益气活血，化痰开窍
D. 平肝潜阳，滋养肝肾
E. 化痰祛湿，健脾和胃

正确答案：E。化痰祛湿，健脾和胃

解析：本题考查眩晕之痰湿中阻证的治法。结合患者症状为眩晕之痰湿中阻证，应采用的治法是化痰祛湿，健脾和胃（E对）。眩晕之痰湿中阻证【症状】眩晕，头重昏蒙，或伴视物旋转，胸闷恶心，呕吐痰涎，食少多寐。舌苔白腻，脉濡。【治法】化痰祛湿，健脾和胃。眩晕之气血亏虚证【症状】眩晕动则加剧，劳累即发，面色淡白，神疲乏力，倦怠懒言，唇甲不华，发色不泽，心悸少寐，纳少腹胀。舌淡苔薄白，脉细弱。【治法】补益气血，调养心脾（A错）。眩晕之肾精不足证【症状】眩晕日久不愈，精神萎靡，两目干涩，视力减退，腰膝酸软，或遗精滑泄，耳鸣齿摇，颧红咽干，五心烦热。舌红少苔，脉细数。【治法】滋养肝肾，益精填髓（B错）。眩晕之肝阳上亢证【症状】眩晕，耳鸣，头目胀痛，口苦，失眠多梦，遇烦劳郁怒而加重，颜面潮红，急躁易怒。舌红苔黄，脉弦或数。【治法】平肝潜阳，滋养肝肾（D错）。